女，1岁，多汗，枕秃，方颅，反复惊厥，不伴发热，血糖3.2mmol/L，钙1.7，镁1.0，磷1.2，患儿最可能的诊断
A. 低镁血症
B. VitD3缺乏性手足搐搦症
C. 婴儿痉挛
D. 低血糖症
E. 甲状旁腺激素减退

正确答案：B。VitD3缺乏性手足搐搦症

解析：多汗，枕秃，方颅，反复惊厥，不伴发热，血糖3.2mmol/L，钙1.7，镁1.0，磷1.2（VitD3缺乏的临床表现）（B对），早期维生素缺乏的婴儿未经治疗，继续加重，出现PTH功能亢进和钙、磷代谢失常的典型骨骼改变，表现部位与该年龄骨骼生长速度较快的部位相一致。